重复
A. 染色体两次断裂后中间节段倒转360度重接
B. 染色体两次断裂后中间节段倒转180度重接
C. 染色体断下节段接到另一染色体上
D. 一条染色体上一个节段进入另一染色体臂内
E. 两同源染色体有相同位点上的插入

正确答案：E。两同源染色体有相同位点上的插入

解析：本题考查重复。重复是指两同源染色体有相同位点上的插入（E对ABCD错）。